关于子宫动脉与输尿管的关系，正确的是
A. 子宫动脉越过其前上方
B. 子宫动脉越过其前下方
C. 子宫动脉与其伴行
D. 子宫动脉越过其后下方
E. 子宫动脉由其内侧绕向外侧

正确答案：A。子宫动脉越过其前上方

解析：子宫动脉越过女性输尿管盆部上方（A对）。